在患者常见的心理问题中，常表现为行为与年龄、社会角色不相符合，像回到婴儿时期，此患者的心理状态被称为
A. 焦虑
B. 回避
C. 猜疑
D. 愤怒
E. 退化

正确答案：E。退化